婴儿生长发育所需的能量
A. 占总能量50%～60%
B. 占总能量25%～30%
C. 占总能量7%～8%
D. 占总能量10%
E. 占总能量5%

正确答案：B。占总能量25%～30%

解析：生长发育，为小儿热量的特殊需要，生长发育越迅速，需要量越大，此项需要量与生长速率成正比。1岁以内婴儿增长最快，这项所需能量约占总热量的25～30%（B对），以后逐渐减少。如饮食所供热量不能满足需要，则生长发育便会迟缓，甚至停止。占总能量50%～60%（A错）为基础代谢率所消耗的能量。占总能量7%～8%（C错）为食物的热力作用所消耗的能量。占总能量10%（D错）为排泄消耗的能量。占总能量5%（E错）为较大儿童食物的热力作用所消耗能量的上限值。